对病原体或其他致病原因开展实验室检测的监测，属于
A. 主动监测
B. 被动监测
C. 哨点监测
D. 以实验室为基础的监测
E. 以医院为基础的监测

正确答案：D。以实验室为基础的监测

解析：本题考查以实验室为基础的监测。以实验室为基础的监测（D对ABCE错）主要是指利用实验室方法对病原体或其他致病因素开展监测。